治疗高脂蛋白血症，首先应该
A. 确定原发、继发
B. 消除危险因素
C. 减肥、戒酒、忌烟
D. 采取膳食控制
E. 进行药物治疗

正确答案：D。采取膳食控制

解析：本题考查高脂蛋白血症的治疗。采取膳食控制（D对）是治疗高脂血症的首选的基本的治疗方式。确定原发、继发（A错）：不论是原发还是继发都要先控制饮食。消除危险因素（B错）与题意无关。减肥、戒酒、忌烟（C错）属于健康生活方式的内容。药物治疗（E错）是在膳食控制不能解决问题时进行的。